有关心动周期的叙述，哪项是错误的
A. 是指心脏机械活动周期
B. 如心率为75次/分，心动周期历时0.8秒
C. 房缩期为0.1秒，室缩期为0.3秒，全心舒张期为0.4秒
D. 心率增快，心动周期缩短
E. 心动周期缩短时，收缩期与舒张期均等缩短

正确答案：E。心动周期缩短时，收缩期与舒张期均等缩短